在底物足量时，生理条件下决定酶促反应速度的是
A. 酶含量
B. 钠离子浓度
C. 温度
D. 酸碱
E. 辅酶含量

正确答案：A。酶含量